缓解急性心肌梗死疼痛最有效的药物是
A. 硝酸异山梨醇酯消心痛
B. 硝酸甘油
C. 吗啡
D. 安痛定
E. 硝苯地平心痛定

正确答案：C。吗啡

解析：心肌梗死是心肌持续而严重的急性缺血导致的心肌坏死。临床表现为突发持久的胸骨后剧烈疼痛，急性循环功能障碍，心律失常，血清心肌坏死标志物增高以及心电图进行性改变，是冠心病的严重类型。所以普通的止痛药对该病没有很好的治疗效果，只有吗啡这种镇痛作用强的药物有作用（C对）。心绞痛发作前常有诱因，休息和含服硝酸甘油能迅速缓解，但不能缓解心肌梗死（B错）。